参与操纵子正调控的蛋白质因子是
A. 辅阻遏蛋白
B. TFⅡB
C. CAP
D. 乳糖
E. 抑制基因

正确答案：C。CAP